对沙眼、结核性眼病及某些病毒性眼病均有治疗作用的药物是
A. 利福平
B. 卡替洛尔
C. 左氧氟沙星
D. 阿托品
E. 利巴韦林

正确答案：A。利福平

解析：本题考查药物的适应证。利福平（A对）、左氧氟沙星（C错）为抗眼部细菌感染药。利福平可用于治疗细菌性外眼感染，如沙眼、结核性眼病及某些病毒性眼病。左氧氟沙星用于治疗细菌性结膜炎、角膜炎、角膜溃疡、泪囊炎等外眼感染。卡替洛尔（B错）为降低眼压的药物，用于青光眼，高眼压症。阿托品（D错）为抗M胆碱类散瞳剂，用于眼底检查及验光前的睫状肌麻痹，眼科手术前散瞳，术后防治粘连。利巴韦林（E错）为抗眼部病毒感染药，用于单纯疱疹病毒性角膜炎。